噪声引起的听觉器官损害特点是早期表现为
A. 耳蜗底部受损
B. 高频听力下降
C. 低频听力下降
D. 语频听力下降
E. 以上都是

正确答案：B。高频听力下降

解析：本题考查早期噪声损害的影响。噪声引起的永久性听阈位移早期常表现为高频听力下降（B对ACDE错），听力曲线在3000～6000Hz（多在4000Hz）出现“v”型下陷，称为听谷。此时病人主观无耳聋感觉，交谈和社交活动能够正常进行。随着病损程度加重，除了高频听力继续下降以外，语言频段（500Hz～2000Hz）的听力也受到影响，出现语言听力障碍，严重可发展至全聋。